患者，女，28岁，体重80kg。12年前于颅脑外伤后出现癫痫全面强直-阵挛性发作，间断有失神发作，最初服用丙戊酸钠缓释片，后因效果不佳，陆续加用奥卡西平片、拉莫三嗪片，三药合用至今已3年；另外间断服用碳酸钙片、骨化三醇胶丸。现患者出现低钠血症，血钠121mmol/L，导致该患者血钠降低的药物可能是
A. 奥卡西平片
B. 丙戊酸钠缓释片
C. 拉莫三嗪片
D. 碳酸钙片
E. 骨化三醇胶丸

正确答案：A。奥卡西平片

解析：本题考查奥卡西平的不良反应。导致该患者血钠降低的药物可能是奥卡西平片（A对）。奥卡西平的不良反应有镇静、疲劳、头晕、恶心、皮疹、低钠血症、共济失调、复视。丙戊酸钠（B错）的不良反应有胃肠道功能紊乱，脱发，体重增加，肝毒性，血小板减少，低纤维蛋白原血症。拉莫三嗪（C错）的不良反应有皮疹、头痛、疲劳、嗜睡、失眠、头晕、震颤、共济失调、背痛、恶心、呕吐、腹泻、攻击行为、易激惹。碳酸钙片（D错）的不良反应有嗳气、便秘。骨化三醇（E错）可能发生的不良反应与维生素D过量相似，如高血钙综合症或钙中毒。